复层鳞状上皮由表层向内的排列顺序为
A. 颗粒层、角化层、棘层和基底层
B. 角化层、颗粒层、棘层和基底层
C. 颗粒层、棘层、角化层和基底层
D. 基底层、棘层、颗粒层和角化层
E. 基底层、角化层、棘层和颗粒层

正确答案：B。角化层、颗粒层、棘层和基底层

解析：复层鳞状上皮由表层向内的排列顺序为角化层、颗粒层、棘层和基底层。掌握“口腔黏膜基本结构”知识点。